男，60岁，口角歪向右侧，左侧鼻唇沟沟消失，闭眼而额纹存在。受累情况是
A. 左侧面神经核受损
B. 右侧面神经核受损
C. 左侧面神经核上瘫
D. 右侧面神经核上瘫
E. 左侧面神经受损

正确答案：D。右侧面神经核上瘫

解析：该患者男，60岁，出现口角歪向右侧，左侧鼻唇沟沟消失，闭眼而额纹存在，结合患者的表现，提示右侧面神经核上瘫，面瘫，口角向健侧偏，核上瘫，患侧额纹眼裂正常鼻唇沟消失，鼓腮（D对ABCE错）。